十二指肠空肠曲借十二指肠悬肌固定于腹后壁，其起始位置在
A. 膈肌右脚
B. 膈肌左脚
C. 膈肌中心腱
D. 膈的食管裂孔附近
E. 膈的腔静脉孔附近

正确答案：A。膈肌右脚

解析：十二指肠空肠去起自膈肌右脚(A对)，借十二指肠悬肌固定于腹后壁。